神经胶质细胞瘤占所有颅内肿瘤的百分比是
A. 10%～15%
B. 20%～30%
C. 40%～50%
D. 60%～70%
E. 70%～80%

正确答案：C。40%～50%

解析：神经胶质细胞瘤又称神经上皮组织肿瘤，指来自神经系统胶质细胞和神经元细胞的颅内肿瘤，占颅内肿瘤的40%～50%（C对）。常见的神经胶质细胞瘤包括星行细胞肿瘤、胶质母细胞瘤、少枝胶质细胞瘤、室管膜瘤、髓母细胞瘤五种。